根据《处方管理办法》，关于医疗机构处方开具和调剂，说法正确的是
A. 药师应对处方用药的临床诊断进行审核
B. 药师对于不规范的处方或者不能确定其合法性的处方，不得调剂
C. 中成药和中药饮片可以开在同一处方，也可以分别开处方
D. 药师应对麻醉药品、第一类精神药品按年月日逐日编写顺序号码
E. 每张处方不得超过3种药品

正确答案：A、B、D。药师应对处方用药的临床诊断进行审核；药师对于不规范的处方或者不能确定其合法性的处方，不得调剂；药师应对麻醉药品、第一类精神药品按年月日逐日编写顺序号码

解析：本题考查处方的开具和调剂。根据《处方管理办法》，关于医疗机构处方开具和调剂，说法正确的是药师应对处方用药的临床诊断进行审核（A对）、药师对于不规范的处方或者不能确定其合法性的处方，不得调剂（B对）、药师应对麻醉药品、第一类精神药品按年月日逐日编写顺序号码（D对）。《处方管理办法》第三十五条规定，药师应当对处方用药适宜性进行审核，审核内容包括：（一）规定必须做皮试的药品，处方医师是否注明过敏试验及结果的判定；（二）处方用药与临床诊断的相符性；（三）剂量、用法的正确性；（四）选用剂型与给药途径的合理性；（五）是否有重复给药现象；（六）是否有潜在临床意义的药物相互作用和配伍禁忌；（七）其他用药不适宜情况。《处方管理办法》第三十九条规定，药师应当对麻醉药品和第一类精神药品处方，按年月日逐日编制顺序号。《处方管理办法》第四十条规定，药师对于不规范处方或者不能判定其合法性的处方，不得调剂。西药和中成药可以分别开具处方，也可以开具一张处方，中药饮片应当单独开具处方（C错）。开具西药、中成药处方，每一种药品应当另起一行，每张处方不得超过5种药品（E错）。